朱砂炮制的目的是
A. 缓和药性
B. 增强疗效
C. 两者均是
D. 两者均不是

正确答案：D。两者均不是

解析：本题考查的是朱砂的炮制作用。朱砂炮制的目的不包括缓和药性或增强疗效（D对）。朱砂采用水飞法炮制。水飞法：指某些不溶于水的矿物药，利用粗细粉末在水中悬浮性不同，将不溶于水的矿物、贝壳类药物经反复研磨，而分离制备极细腻粉的方法。水飞法的目的：①去除杂质，洁净药物。②使药物质地细腻，便于内服和外用，提高其生物利用度。③防止药物在研磨过程中粉尘飞扬，污染环境。④除去药物中可溶于水的毒性物质，如砷、汞等。缓和药性（A错）与增强疗效（B错）为提净法的目的。提净法：指某些矿物药，特别是一些可溶性无机盐类药物，经过溶解，过滤，除净杂质后，再进行重结晶，以进一步纯净药物的方法。提净的目的：①使药物纯净，提高疗效。②缓和药性。③降低毒性。